药物的选择性低则易发生
A. 副作用
B. 毒性反应
C. 后遗效应
D. 停药反应
E. 变态反应

正确答案：A。副作用

解析：副作用，由于药物的选择性低，药理效应涉及多个器官，当某一效应用做治疗目的时，其他效应就成为副作用。掌握“药物不良反应”知识点。